软膏剂的质量评价不包括
A. 硬度
B. 黏度与稠度
C. 主药含量
D. 装量
E. 微生物限度

正确答案：A。硬度